原发性下肢静脉曲张与营养障碍密切相关的并发症是
A. 足靴区皮肤溃疡
B. 血栓性静脉炎
C. 下肢水肿
D. 小腿皮下瘀血
E. 局部血管破裂出血

正确答案：A。足靴区皮肤溃疡

解析：原发性下肢静脉曲张与营养障碍密切相关的并发症是足靴区皮肤溃疡（A对）。血栓性静脉炎（B错）、下肢水肿（C错）、小腿皮下瘀血（D错）、局部血管破裂出血（E错）等与营养障碍无关。